初孕妇，25岁。妊娠33周，BP150/90mmHg，尿蛋白0.5g/24h。该患者属于
A. 妊娠期高血压
B. 子痫前期
C. 重度子痫前期
D. 子痫
E. 慢性高血压合并子痫前期

正确答案：B。子痫前期

解析：25岁初孕妇，妊娠33周，BP150/90mmHg（轻度子痫前期收缩压≥140mmHg和（或）舒张压≥90mmHg），应诊断为子痫前期（B对）。妊娠期高血压疾病是一组妊娠与血压升高并存的一组疾病，包括妊娠期高血压、子痫前期、子痫、慢性高血压合并子痫前期、慢性高血压合并妊娠。妊娠期高血压（A错）的患者高血压于产后12周内恢复正常，尿蛋白（﹣），产后方可确诊。重度子痫前期（C错）患者的收缩压≥160mmHg和（或）舒张压≥110mmHg，蛋白尿≥5.0g/24h。子痫（D错）是在子痫前期的基础上发生了不明原因的抽搐。慢性高血压合并子痫前期（P66）（E错）是指慢性高血压孕妇妊娠前无蛋白尿，妊娠后出现蛋白尿≥0.3g/24h；或妊娠前有蛋白尿，妊娠后蛋白尿明显增加或血压进一步升高或出现血小板减少。